清热燥湿药的性味多为
A. 苦寒
B. 甘寒
C. 辛苦温
D. 甘苦温
E. 甘辛温

正确答案：A。苦寒

解析：清热燥湿药性味苦寒，苦能燥湿，寒能清热，以清热燥湿为主要作用，主要用治湿热证（A对）。